长期使用解热药或激素类药后，常出现的热型是
A. 消耗热
B. 不规则热
C. 回归热
D. 稽留热
E. 弛张热

正确答案：B。不规则热

解析：结核病、风湿热常见热型为不规则热，且结核病、风湿热患者长期服用解热药或激素类药物，故长期使用解热药或激素类药后，常出现的热型是不规则热（B对）。回归热（C错）常见于回归热、霍奇金病等。稽留热（D错）常见于大叶性肺炎、斑疹伤寒等。弛张热（E错）常见于败血症、风湿热等。热型中无消耗热（A错）。